某牙根四周均为垂直吸收的骨下袋，牙根位于骨下袋中央，骨壁与牙根不相贴合，此牙周袋称为
A. 一壁骨袋
B. 二壁骨袋
C. 三壁骨袋
D. 四壁骨袋
E. 混合骨袋

正确答案：D。四壁骨袋

解析：本题考查牙槽骨破坏的形式-垂直型吸收。某牙根四周均为垂直吸收的骨下袋，牙根位于骨下袋中央，骨壁与牙根不相贴合，此牙周袋称为四壁骨袋（D对）。骨下袋根据骨质破坏后剩余的骨壁数目，可以分为一壁骨袋、二壁骨袋、三壁骨袋、四壁骨袋和混合壁袋。一壁骨袋牙槽骨破坏严重，仅存留一侧骨壁（A错）。二壁骨袋一般见于相邻两牙的骨间隔破坏，仅存颊、舌两壁（B错）。三壁骨袋的一个壁是牙根面，颊舌邻面都有骨壁（C错）。四壁骨袋牙根位于骨下袋中央，骨壁与牙根不相贴合。混合骨袋垂直吸收各个骨壁高度不同，骨下袋近根尖部骨壁数目多于近冠端骨壁（E错）。